用于气体灭菌养护技术的最佳气体是
A. 氟利昂
B. 环氧乙烷混合气体
C. 环氧乙烷
D. 二氧化碳混合气体
E. 氧气和氮气混合物

正确答案：B。环氧乙烷混合气体

解析：本题考查的是气体灭菌养护技术。用于气体灭菌养护技术的最佳气体是环氧乙烷混合气体（B对）。气体灭菌养护技术：气体灭菌主要是指环氧乙烷防霉技术及混合气体防霉技术。环氧乙烷（C错）是一种气体灭菌杀虫剂，可与细菌蛋白分子中氨基、羟基、酚基或巯基中的活泼氢原子，起加成反应生成羟乙基衍生物，使细菌代谢受阻而产生不可逆的杀灭效果，有较强的扩散性和穿透力，有杀灭各种细菌、霉菌及昆虫、虫卵的作用。但环氧乙烷的沸点较低，有易燃易爆的危险，因此可应用环氧乙烷混合气体，它是由环氧乙烷与氟利昂（A错）按国际通用配方组成，具有灭菌效果可靠、安全、操作简便等优点。